有些人在面对应激事件时易采用“钻牛角尖”的方式应对，这种应对方式属于
A. 自我防御反应
B. 情绪反应
C. 行为反应
D. 生理反应
E. 认知反应

正确答案：E。认知反应

解析：应激的心理反应包括情绪性应激反应、认知性应激反应、行为性应激反应，这三方面的反应不是孤立的，通常是双向调节，构成一个反馈回路系统。认知性应激反应是指应激时唤起注意和认知过程，以适应和应对外界环境变化。但应激较剧烈时，认知能力普遍下降。常见的认知性应激反应表现为：意识障碍，如意识朦胧、意识范围狭小：注意力受损，表现为注意力集中困难、注意范围狭窄等：记忆、思维、想象力减退等。这些负面的认知性应激反应使人陷入灾难中，难以自拔，如偏执个体在应激后出现认知狭窄、偏激、钻牛角尖（E对），平日非常理智的人变得固执、蛮不讲理。也可表现为过分的自我关注，注意自身的感受、想法、信念等内部世界，而非外部世界。情绪性应激反应（B错）包括焦虑、抑郁、恐惧、愤怒。行为性应激反应（C错）包括积极及消极的行为应对反应。积极的行为性应激可为患者减少压力，甚至可以激发主体的能动性，激励主体克服困难，战胜挫折，而消极的行为性应激则会使个体出现回避、退缩等行为。